有偏瘫同向性偏盲偏身感觉障碍，见于
A. 椎-基底动脉血栓形成
B. 大脑前动脉血栓形成
C. 大脑中动脉血栓形成
D. 蛛网膜下腔出血
E. 小脑出血

正确答案：C。大脑中动脉血栓形成

解析：偏瘫同向性偏盲偏身感觉障碍，可见于基底核区病变。基底核由大脑中动脉供血，当大脑中动脉血栓形成（C对）、栓塞或出血时会导致的基底核区功能障碍，出现三偏症状，即病灶对侧偏瘫（中枢性面舌瘫和肢体瘫痪）、偏身感觉障碍及偏盲（三偏）。大脑前动脉血栓形成（B错）可导致大脑前动脉供血区出血，可出现人格和情感障碍、对侧下肢无力等（P178）。椎-基底动脉血栓形成（A错）可出现阵发性眩晕、眼震以及构音障碍、交叉性瘫痪等脑干缺血综合征（P178）。蛛网膜下腔出血（D错）表现为头痛、脑膜刺激征、眼部症状、谵妄和幻觉等（P173）。小脑出血（E错）表现为频繁呕吐、枕部剧烈疼痛、行动不稳、共济失调和眼球震颤（P190）。